肾功能减退时，应避免使用或调整给药方案的有
A. 万古霉素
B. 庆大霉素
C. 阿米卡星
D. 小檗碱
E. 替考拉宁

正确答案：A、B、C、E。万古霉素；庆大霉素；阿米卡星；替考拉宁

解析：本题考查特殊人群用药。肾功能减退时，应避免使用或调整给药方案的有万古霉素（A对）、庆大霉素（B对）、阿米卡星（C对）、替考拉宁（E对）。四者具有肾毒性，肾功能减退时，应避免使用或调整给药方案。小檗碱（D错）无明显肾毒性。